男性，30岁。上前牙牙体变色半年余。无自发痛。曾有外伤史，牙体检查无龋损及其他牙体硬组织病变。X线片示：根尖无明显异常。牙髓活力电测验无反应。叩诊（-），无松动，牙周检查（-）。应诊断为
A. 慢性闭锁性牙髓炎
B. 牙髓坏死
C. 牙髓钙化
D. 慢性根尖周炎
E. 慢性牙周炎

正确答案：B。牙髓坏死

解析：本题考查牙髓坏死。男性，30岁。上前牙牙体变色半年余。无自发痛。曾有外伤史，牙体检查无龋损及其他牙体硬组织病变。X线片示：根尖无明显异常。牙髓活力电测验无反应。叩诊（-），无松动，牙周检查（-）。应诊断为牙髓坏死（B对）。根据题目中的信息上前牙牙体变色半年余，X线片显示根尖无明显异常，牙髓活力电测验无反应，可诊断为牙髓坏死。慢性闭锁性牙髓炎，患者都有长期的冷热刺激痛史，无明显自发痛，对温度的反应为敏感，也可为迟热侧引起的迟缓性疼痛，多有叩痛（+）或叩诊不适感（A错）。牙髓钙化，X线为重要的诊断依据，X线片示髓腔内有阻射物（C错）。慢性根尖周炎，X线显示出患牙根尖区骨质的变化，可根据不同的影像提示不同类型（D错）。慢性牙周炎为牙周疾病，主要特征有牙周袋形成、牙龈炎症、牙周附着丧失、牙槽骨吸收（E错）。